对物料恒速干燥阶段的表述，不正确的是
A. 物料内部的水分及时补充到物料表面
B. 物料表面的水分气化过程完全与纯水的气化情况相同
C. 干燥速率主要受物料外部条件的影响
D. 提高空气流速可以加快干燥速率
E. 降低空气温度或提高空气中湿度可以加快干燥速率

正确答案：E。降低空气温度或提高空气中湿度可以加快干燥速率